一病人于3小时前从2米高处跌下，左腰部撞击伤，无昏迷，血压正常，左腰部疼痛伴轻压痛，无包块，尿常规RBC5～10个/HP，最可能的诊断是
A. 肾挫伤
B. 肾部分裂伤
C. 肾全层裂伤
D. 肾蒂断裂
E. 输尿管损伤

正确答案：A。肾挫伤

解析：病人左腰部撞击伤（提示可能有肾损伤）史，无昏迷，血压正常（提示损伤较轻），左腰部疼痛伴轻压痛，无包块，尿常规RBC5～10个/HP（正常值为0～3个/HP，提示轻度肾损伤），结合患者病史、临床表现和相关检查，最可能的诊断为肾挫伤（A对）。肾部分裂伤（B错）、肾全层裂伤（C错）均会出现明显血尿，腰腹部可触及肿块；肾蒂断裂（D错）可迅速出现血尿、休克等表现，病情危急；输尿管损伤（E错）多为医源性损伤，可表现为血尿、尿外渗、尿瘘等症状，常需要借助相关检查得以确诊。